活髓切断术的原理是利用牙髓的哪项功能
A. 感觉功能
B. 营养功能
C. 免疫反应
D. 形成牙本质
E. 牙髓组织的再生功能

正确答案：D。形成牙本质

解析：本题考查牙髓的生物学功能。活髓切断术的原理是利用牙髓的形成牙本质（D对）。牙髓具有4种基本功能：①成牙本质细胞形成牙本质；②血液系统向牙髓牙本质复合体提供营养成分；③感觉神经纤维传导痛觉；④成牙本质细胞及结缔组织成分对外界刺激的保护性反应。活髓切断术即牙髓切断术，是切除炎症牙髓组织，以盖髓剂覆盖牙髓断面，保留正常牙髓组织的方法。牙髓在受到外界刺激时可以形成修复性牙本质，活髓切断术就是根据牙髓的这个功能，将炎症牙髓切除，在牙髓断面上覆盖盖髓剂，如氢氧化钙或MTA有诱导牙髓形成修复性牙本质的功能，从而在断面上形成牙本质桥，封闭根管口，使根髓保持正常活力。营养功能（B错）主要是营养牙髓牙本质复合体，提高牙齿强度和抗力。牙髓中含有神经纤维，有感觉功能（A错）；含有淋巴细胞，具有一定的免疫反应（C错），但是这都与活髓切断术无关。牙髓中还含有未分化间充质细胞，有高度增值、自我更新、多向分化的潜能，但是牙髓组织是不可再生组织，即牙髓不可再生（E错）。